足少阴肾经的主治特点是
A. 心病
B. 心胃病
C. 肺喉病
D. 肾病肺病咽喉病
E. 前头口齿咽喉病，胃肠病

正确答案：D。肾病肺病咽喉病

解析：足少阴肾经主治肾、肺、咽喉病（D对）。手少阴心经主治心病（A错）；手厥阴心包经主治心、胃病（B错）；手太阴肺经主治肺、喉病（C错）；足阳明胃经主治前头、口齿、咽喉、胃肠病（E错）。